梅罗综合征的临床表现是
A. 沟纹舌、面瘫、口角炎
B. 沟纹舌、面瘫、腺性唇炎
C. 沟纹舌、面瘫、肉芽肿性唇炎
D. 地图舌、面瘫、口角炎
E. 地图舌、口角炎、肉芽肿性唇炎

正确答案：C。沟纹舌、面瘫、肉芽肿性唇炎

解析：本题考查梅罗综合征的临床表现。梅-罗综合征的临床特征有复发性口面部肿胀、复发性面瘫、裂舌。肉芽肿性唇炎是其表现之一（C对）。口角炎（ADE错）是发生于上下唇两侧联合处口角区的炎症症状，以皲裂、口角糜烂和结痂为主要症状。腺性唇炎（B错）是以唇腺增生肥大、下唇肿胀或偶见上下唇同时肿胀为特征的唇炎，病损主要累及唇口缘及唇部内侧的小唾液腺，是唇炎中较少见的一种疾病。